目前我国引起痢疾的优势血清群有
A. 宋内志贺菌
B. 福氏志贺菌
C. 鲍氏志贺菌
D. 痢疾志贺菌
E. A+B

正确答案：E。A+B